慢性阻塞性肺疾病产生呼气性呼吸困难主要机制是
A. 中央性气道阻塞
B. 呼气时气道内压大于大气压
C. 胸内压升高压迫气道，气道狭窄加重
D. 肺泡扩张，小气道口径变大，管道伸长
E. 小气道阻力增加

正确答案：E。小气道阻力增加

解析：慢性阻塞性肺疾病产生呼气性呼吸困难主要机制是管径小于2mm的小气道阻塞和阻力增高（E对）。